关于抗癫痫药物合理使用的说法，正确的有
A. 抗癫痫药物规律服用半年后，如无发作方可停
B. 服用感冒药时，为避免药物相互作用，应暂停抗癫痫药物
C. 如果发作频繁，应在医生指导下增加药量或更换药物
D. 抗癫痫药物半衰期长，均可一日一次给药
E. 治疗期间应定期复查血常规与肝功能

正确答案：B、C、E。服用感冒药时，为避免药物相互作用，应暂停抗癫痫药物；如果发作频繁，应在医生指导下增加药量或更换药物；治疗期间应定期复查血常规与肝功能

解析：本题考查抗癫痫药物。感冒药含对乙酰氨基酚，其与卡马西平合用使肝毒性增加，疗效降低，因此服用感冒药应暂停抗癫痫药物（B对）；如果癫痫患者发作频繁，应在医生指导下增加药量或更换药物（C对）；应用抗癫痫药物治疗期间应定期复查血常规与肝功能（E对）。